正确描述输尿管的是
A. 起于肾盏，终于膀胱
B. 全长35～40cm
C. 分为腹、盆两段
D. 管腔有两狭窄
E. 女性输尿管在子宫外侧缘2.5cm处子宫动脉跨其前方

正确答案：E。女性输尿管在子宫外侧缘2.5cm处子宫动脉跨其前方

解析：输尿管全长20~30cm（B错），上端起自肾盂，下端终于膀胱（A错），可分为三段即腹段、盆段、壁内段（C错），有三处生理性狭窄（D错）。在子宫外侧缘2.5cm处子宫动脉跨其前方（E对）是女性输尿管盆部的特点。